用于治疗梅毒的药物是
A. 氯霉素
B. 青霉素
C. 替莫西林
D. 四环素
E. 利福平

正确答案：B。青霉素

解析：本题考查青霉素。用于治疗梅毒的药物是青霉素（B对）。氯霉素（A错）为敏感菌株所致伤寒、副伤寒的首选药物。替莫西林（C错）为耐β-内酰胺酶的半合成青霉素。对革兰阴性菌有高度抗菌活性。四环素（D错）高浓度时具杀菌作用。利福平（E错）为利福霉素类半合成广谱抗菌药。